无腕外展作用的肌是
A. 桡侧腕屈肌
B. 桡侧腕长伸肌
C. 桡侧腕短伸肌
D. 尺侧腕屈肌
E. 拇长展肌

正确答案：D。尺侧腕屈肌

解析：尺侧腕屈肌（D错，为本题正确答案）屈和内收腕，屈肘，无腕外展作用。